医德修养的根本途径是
A. 不断地学习医德理论知识
B. 创造一个良好的医德修养氛围
C. 向医德高尚的医务人员学习
D. 坚持在医疗卫生保健实践中修养
E. 坚持有的放矢的医德修养

正确答案：D。坚持在医疗卫生保健实践中修养

解析：医德修养是指医务人员按照社会所倡导的医德理念及其规范，在医德实践中进行自我教育、自我评价、自我锻炼和自我陶冶的过程及其所达到的医德境界。医德修养来源于医疗实践，又服务于实践，因此医德修养最根本的途径、最重要的方法是坚持在医疗卫生保健实践中修养（D对）。不断的学习医德理论知识（A错）、创造一个良好的医德修养氛围（B错）、向医德高尚的医务人员学习（C错）、坚持有的放矢的医德修养（E错）只是医德修养的一般途径。